女，20岁。春天在花园中游玩时突然晕倒。入院时查体：脉搏细速，BP40/20mmHg，面色苍白，神志不清。其首要的救治措施是
A. 多巴胺20mg静滴
B. 地塞米松15mg静滴
C. 给氧、严密监护
D. 肾上腺素1mg皮下注射
E. 安定10mg静滴

正确答案：D。肾上腺素1mg皮下注射

解析：患者游玩中突然晕倒，脉搏细速、面色苍白、神志不清、血压40/20mmHg（通常认为收缩压＜90mmHg、脉压＜20mmHg），提示出现过敏性休克。其首要的救治措施是给予肾上腺素1mg皮下注射（D对）。肾上腺素可兴奋心肌、收缩血管、升高血压及增加冠状动脉血流，输入后可迅速开始发挥作用，保证机体重要器官灌注压以挽救生命。多巴胺可同时兴奋α和β₁受体，但其药理作用可因剂量大小的不同而不同。当采用＜10μg/（kg·min）的小剂量时，可以增强心肌收缩力和增加CO，并扩张肾和胃肠道等内脏器官的血管；当采用＞15μg/（kg·min）的大剂量时，可增加外周血管阻力。抗休克的治疗过程中多采取小剂量多巴胺以强心及扩张内脏血管，而不采用多巴胺20mg静滴（A错）的治疗方案。地塞米松15mg静滴（B错）主要用于感染性休克及严重休克患者的治疗，可舒张血管以改善微循环、可增加心肌收缩力。对过敏性休克，糖皮质激素为次选药，可与首选药肾上腺素合用，对病情较重或发展较快者，同时静脉滴注氢化可的松200～400mg。给氧、严密监护（C错）为抗休克的一般治疗，不作为急救的首选。安定（E错）即地西泮，主要用于镇静、抗焦虑及癫痫持续状态的治疗，对已休克患者应用安定容易出现深昏迷。